男性，16岁。能量供给量为2900kcal，蛋白质提供的热能占总热能的12%。该学生蛋白质的供给量应是
A. 65g
B. 76g
C. 80g
D. 87g
E. 92g

正确答案：D。87g